在肺癌筛查时，若筛查组中疾病进展缓慢的病人占较大比例时，可能观察到筛查组较未筛查组生存概率更高或生存时间更长，可能产生的偏倚是
A. 领先时间偏倚
B. 病程偏倚
C. 志愿者偏倚
D. 过度诊断偏倚
E. 信息偏倚

正确答案：B。病程偏倚

解析：本题考查病程偏倚的概念。病程偏倚（B对ACDE错）是指如果筛查组中疾病进展缓慢的病人（肺癌腺癌）占较大比例时，可能观察到筛查组较未筛查组生存概率更高或生存时间更长的现象。